血浆凝固酶是金黄色葡萄球菌产生的侵袭性酶，其主要不包括
A. 有助于感染扩散
B. 抗吞噬
C. 特异识别作用
D. 菌种鉴别
E. 刺激产生抗体

正确答案：A。有助于感染扩散

解析：血浆凝固酶是金黄色葡萄球菌产生的侵袭性酶，其繁殖引起的周围纤维蛋白沉积和凝固使感染易于局限化。凝固酶阳性菌株进入机体后，使周围血液或血浆中的纤维蛋白等沉积于细菌表面，阻碍吞噬细胞的吞噬或胞内消化作用（B对）。凝固酶具有免疫原性（C对），能剌激机体产生抗体（E对）。该酶使加有抗凝剂的人或兔血浆凝固，可作为鉴定致病性葡萄球菌的重要指标（D对）。